患者，女性，56岁。因风湿性心脏病给予地高辛0.5mg/d，连续治疗1个月后，病情好转，但病人出现恶心呕吐，黄视等症状。经检查：心电图：PP间期和PR间期延长；地高辛血浓度为3.2ng/ml。诊断为地高辛中毒。除立即停药外，还应采用什么药治疗
A. 苯妥英钠
B. 利多卡因
C. 普萘洛尔
D. 钾盐
E. 阿托品

正确答案：E。阿托品